流行病学研究的主要用途是
A. 进行统计学检验
B. 探讨病因与影响流行的因素及确定预防方法
C. 研究疾病的发生概率
D. 研究疾病的临床表现
E. 研究疾病的死亡情况

正确答案：B。探讨病因与影响流行的因素及确定预防方法

解析：本题考查流行病学研究的用途。流行病学研究的主要用途是探讨病因与影响流行的因素及确定预防方法（B对ACDE错）。此外还有疾病预防和健康促进，疾病的监测，疾病病因和危险因素研究，疾病的自然史，疾病的防治效果评价。